在我国最多见的淋巴瘤类型是
A. 弥漫性大B细胞淋巴瘤
B. NK/T细胞淋巴瘤
C. MALT淋巴瘤
D. 蕈样霉菌病
E. 滤泡性淋巴瘤

正确答案：A。弥漫性大B细胞淋巴瘤

解析：在我国最多见的淋巴瘤类型是弥漫性大B细胞淋巴瘤（A对），占所有淋巴瘤的33.27%。滤泡性淋巴瘤较西方人群相对少见，而T细胞及NK细胞淋巴瘤在我国人群相对多见（占所有淋巴瘤的21.38%），霍奇金淋巴瘤占所有淋巴瘤的构成比为8.54%，且最常见的亚型为混合细胞型和结节硬化型。